四头带临床上常用一段绷带，将其两端剪开一定长度，形成四个带头即可。带的长度一般为
A. 35cm
B. 50cm
C. 70cm
D. 80cm
E. 100cm

正确答案：C。70cm

解析：四头带应用技术：四头带亦称四尾带，其制作方法简便，临床上常用一段绷带，将其两端剪开一定长度，形成四个带头即可。带的长度一般为70cm左右，剪开的长度视需要而定。掌握“口外创口处理”知识点。